面横裂
A. 上颌突与内侧鼻突融合障碍
B. 上颌突与外侧鼻突未能融合
C. 上颌突与下颌突未能融合
D. 原发腭突与继发突融合障碍
E. 两个内侧鼻突未能正常融合

正确答案：C。上颌突与下颌突未能融合

解析：上颌突与下颌突未能融合则形成面横裂。掌握“唇腭裂概述”知识点。